关于侵袭性牙周炎表述正确的是
A. 与慢性牙周炎区别不明显
B. 发生于全身健康者
C. 无家族聚集性
D. 疾病进展缓慢
E. 以上均正确

正确答案：B。发生于全身健康者

解析：本题考查侵袭性牙周炎。关于侵袭性牙周炎表述正确的是发生于全身健康者（B对）。侵袭性牙周炎是一组在临床表现和实验室检查（包括化验和微生物学检查）均与慢性牙周炎有明显区别的牙周炎（A错），发生于全身健康者，具有家族聚集性（C错），疾病进展迅速（D错）。